传导躯干和四肢的意识性本体觉传导通路，第2级神经元发出的轴突交叉部位在
A. 脊髓
B. 延髓
C. 中脑
D. 脑桥
E. 丘脑

正确答案：B。延髓

解析：传导躯干和四肢的意识性本体觉传导通路，第2级神经元发出的轴突交叉部位在延髓（B对）水平，最终投射到中央后回上2/3和中央旁小叶后部。